翼腭间隙向下经哪个部位通向口腔
A. 切牙孔
B. 圆孔
C. 卵圆孔
D. 翼腭管
E. 颏孔

正确答案：D。翼腭管

解析：翼腭间隙向前经眶下裂通眼眶，向内经蝶腭孔通鼻腔，向外经翼上颌裂通颞下间隙，向下经翼腭管通口腔，向后上经圆孔通颅腔。掌握“面侧深区及颌面部各间隙的境界”知识点。